高温车间是指
A. 夏季车间内气温超过30℃
B. 夏季车间内气温超过35℃
C. 车间内气温比室外夏季设计通风计算温度高1℃及以上
D. 车间内热源散热量每小时每平方米大于50kcal
E. 热源散热量大于23W/m²的车间

正确答案：E。热源散热量大于23W/m²的车间